患者，女，35岁。黄疸贫血伴关节酸痛3个月，体检检査巩膜黄染，脾肋下2cm，血红蛋白58g/L，白细胞5×10⁹/L，网织红细胞计数25%，外周血涂片成熟红细胞形态正常，尿隐血试验阴性。明确诊断应作哪项检査
A. 肝功能
B. Coombs试验
C. CT
D. 免疫球蛋白
E. 骨髓检查

正确答案：B。Coombs试验

解析：患者诊断为溶血性贫血，尿隐血试验阴性，可排除血管内溶血，考虑血管外溶血可能性大，血管外溶血以自身免疫性溶血性贫血多见，后者又以温抗体型自身免疫性溶血性贫血为多，Coombs试验是温抗体型自身免疫性溶血性贫血最具诊断意义的实验室检查，因此为明确诊断可做Coombs试验（B对）。肝功能（A错）可用于诊断急性黄疸型肝炎；CT（C错）可用于诊断肝癌骨转移；免疫球蛋白（D错）特异性差，诊断价值不大；骨髓检查（P572）（E错）可用于诊断急性白血病。